短时记忆存储的信息量为
A. 3±2
B. 5±2
C. 7±2
D. 9±2
E. 11±2

正确答案：C。7±2

解析：此题为概念题。根据记忆中信息保持时间的长短，将记忆分为感觉记忆、短时记忆和长时记忆。瞬时记忆的信息在感觉系统存留时间仅有0.25～2秒钟，具有鲜明的形象性。短时记忆是瞬时记忆和长时记忆的中间阶段，信息在头脑中存留5秒钟～2分钟，信息储存量有限，一般为7±2个记忆单位（C对）。长时记忆是指信息经过深人加工在头脑中长期贮存的记忆。